会导致眼压升高出现青光眼，也可能出现白内障的药物是
A. β-内酰胺类抗生素
B. 氨基糖苷类抗生素
C. 喹诺酮类抗菌药
D. 糖皮质激素类药物
E. 非甾体抗炎药

正确答案：D。糖皮质激素类药物

解析：本题考查糖皮质激素类药物。会导致眼压升高出现青光眼，也可能出现白内障的药物是糖皮质激素类药物（D对）。长期大剂量糖皮质激素类药物应用可引起骨质疏松症、高血压、糖尿病、下丘脑垂体与肾上腺轴的抑制、肥胖症、白内障、青光眼、肌无力、皮肤变薄导致皮纹和瘀斑。β-内酰胺类抗生素（A错）不良反应有过敏反应、胃肠道反应、药物热、二重感染、肾损害等。氨基糖苷类抗生素（B错）的不良反应有耳毒性、肾毒性、神经肌肉阻断、少见皮疹、发热、血管神经性水肿及剥脱性皮炎等。喹诺酮类抗菌药（C错）的不良反应有影响软骨发育、胃肠道反应、中枢反应和诱发癫痫等。非甾体抗炎药（E错）的不良反应有胃肠道反应、变态反应、肝肾损害等。